属于含氟牙膏成分的是
A. 洗必泰
B. 单氟磷酸钠
C. 氯化钾
D. 三氯羟苯醚
E. 氧化剂

正确答案：B。单氟磷酸钠

解析：几种主要的含氟牙膏：单氟磷酸钠牙膏、氟化亚锡牙膏、氟化钠牙膏、氟化胺牙膏。掌握“自我口腔保健方法”知识点。